运动员进行高低杠训练及比赛时，常采取的运动损伤预防措施是
A. 安全防范法
B. 保护帮助法
C. 量力适应法
D. 准备活动法
E. 消除疲劳法

正确答案：B。保护帮助法